心可舒胶囊的功能是
A. 活血化瘀，化痰通络
B. 益气养血，通脉止痛
C. 活血化瘀，行气止痛
D. 益气养阴，活血通络
E. 益气活血，通络止痛

正确答案：C。活血化瘀，行气止痛

解析：本题考查的是心可舒胶囊的功能。心可舒胶囊的功能是活血化瘀，行气止痛（C对）。心可舒胶囊：【功能】活血化瘀，行气止痛。华佗再造丸：【功能】活血化瘀，化痰通络（A错），行气止痛。参松养心胶囊：【功能】益气养阴，活血通络（D错），清心安神。通心络胶囊：【功能】益气活血，通络止痛（E错）。功能为益气养血，通脉止痛（B错）的中成药，2022年考试指南未明确说明。